流脑暴发型败血症型的发病机制是
A. 高热，失水性休克
B. 急性肾上腺皮质功能衰竭所致
C. 外毒素引起的多脏器功能衰竭
D. 内毒素所致的严重微循环障碍，D1C
E. 血管内皮损伤血浆外渗所致低血容量休克

正确答案：D。内毒素所致的严重微循环障碍，D1C

解析：细菌释放的内毒素是本病致病的重要因素。内毒素引起全身的施瓦茨曼反应，激活补体，血清炎症介质明显增加，产生循环障碍和体克。脑膜炎奈瑟菌内毒素较其他内毒索更易激活激血系统，因此在休克早期便出现弥散性血管内凝血（DIC）及继发性纤溶亢进，进一步加重微循环障碍、出血和休克，最终造成多器官功能衰竭（D对）。